队列研究设计在确定暴露因素时要全面考虑的问题有
A. 定量指标、暴露水平、暴露时间、暴露连续性
B. 定性指标、暴露早晚、暴露方式、暴露终止时间
C. 等级指标、暴露先后、暴露主次、暴露起始期
D. 量化指标、暴露有无、暴露来源、暴露间歇期
E. 概率指标、暴露性质、暴露强弱、暴露组距长短

正确答案：A。定量指标、暴露水平、暴露时间、暴露连续性